男性，52岁，因库欣（Cushing）综合征接受一侧肾上腺全切，另一侧全切手术5年，因高血压，低血钾，肥胖再次就诊，临床及实验室诊断为库欣（Cushing）综合征复发，病人有慢性心衰史2年，应首先选择的治疗是
A. 再次肾上腺手术
B. 化疗
C. 酮康唑治疗
D. 安体舒通治疗
E. 降压治疗补钾

正确答案：C。酮康唑治疗

解析：中年男性患者，既往因库欣综合征切除双侧肾上腺手术史，慢性心衰史，再发高血压，低血钾，肥胖，临床及实验室诊断为库欣综合征复发，应首先选择的治疗是酮康唑治疗，酮康唑对肾上腺肿瘤疗效迅速，为库欣综合征最常用治疗药物之一，与其他抗糖皮质激素合成药物相比，无ACTH反馈升高的副作用，故长期用于异位ACTH综合征治疗。患者已将双侧肾上腺全部切除，故不可能再次肾上腺手术及化疗（AB错）。安体舒通（螺内酯）（D错）主要用于治疗醛固酮增多症。降压治疗补钾（E错）可以根据临床表现作为对症辅助治疗，不是首选治疗。